需要专业人员使用的是
A. 1.23%含氟凝胶
B. 氟滴剂
C. 牛奶氟化
D. 食盐氟化
E. 饮水氟化

正确答案：A。1.23%含氟凝胶

解析：1.23%含氟凝胶：是供口腔专业人员实施的，用于医院和口腔诊所。掌握“氟的全身及局部应用”知识点。